热牙胶作牙髓活力测验，操作正确的是置于
A. 牙唇（颊）面中1/3处
B. 咬合面窝沟处
C. 龋洞中
D. 牙唇（颊）面（牙合）1/3处
E. 牙尖

正确答案：A。牙唇（颊）面中1/3处

解析：本题考查牙髓温度测验-热诊法。热牙胶作牙髓活力测验，操作正确的是置于牙唇（颊）面中1/3处（A对）。热牙胶作牙髓活力测验应置于牙唇（颊）面中1/3处，此处距离牙髓相对较近，测试结果更可靠。若置于咬合面窝沟处，因为点隙窝沟的存在，热牙胶不能很好的与牙面接触，效果不好（B错）。由于牙本质可传导冷热刺激至牙髓，引起牙髓反应，作温度测验时，若将牙胶棒置于龋洞中，则测验结果不准确（C错）。牙唇（颊）面（牙合）1/3、牙尖处，距离髓腔相对较远，测试结果准确性较低（DE错）。